后筛窦开口于
A. 上鼻道
B. 中鼻道
C. 蝶筛隐窝
D. 筛漏斗
E. 下鼻道

正确答案：A。上鼻道

解析：后筛窦开口于上鼻道（A对）。